在半年时间里，老师将字母“A”和“apple”同时教授给3岁幼儿，并用苹果做道具，每周都进行复习，幼儿所产生的记忆为
A. 感觉性记忆
B. 逻辑性记忆
C. 第一记忆
D. 第二记忆
E. 第三记忆

正确答案：E。第三记忆